1条mRNA模板链都可附着的核蛋白体量是
A. 10～30个
B. 20～50个
C. 10～100个
D. 30～100个
E. 30～150个

正确答案：C。10～100个

解析：无论在原核细胞还是真核细胞内，1条mRNA模板链都可附着10～100个核蛋白体，这些核蛋白体依次结合起始密码子并沿5’→3’方向读码移动，同时进行肽链合成。掌握“蛋白质的生物合成”知识点。